DiGeorge综合征属于
A. B细胞缺陷病
B. T细胞缺陷病
C. 联合免疫缺陷病
D. 吞噬细胞缺陷病
E. 补体缺陷病

正确答案：B。T细胞缺陷病

解析：DiGeorge综合征是由于先天性胸腺发育不全引起的T细胞缺陷病。患儿唇和耳等发育不良，T细胞数目降低，B细胞数目正常。临床表现为易反复感染病毒、真菌、原虫及胞内寄生菌。掌握“免疫缺陷概述及原发性、获得性免疫缺陷病”知识点。